黏性药材及无组织结构药材的浸提应采用
A. 煎煮法
B. 浸渍法
C. 渗漉法
D. 水蒸气蒸馏法
E. 超临界流体提取法

正确答案：B。浸渍法